正常小儿前囟闭合的时间应是
A. 6个月～12个月
B. 12个月～18个月
C. 1.5岁～2岁
D. 2岁～2.5岁
E. 2.5岁～3岁

正确答案：C。1.5岁～2岁

解析：前囟出生时约1～2cm，以后随颅骨生长而增大，6月龄左右逐渐骨化而变小，最迟于2岁闭合。第八版与第九版儿科学均未提及前囟一般闭合时间，仅提到最迟于2岁闭合，故答案选1.5岁-2岁。